使血尿酸水平提高的食物和药品是
A. 阿司匹林
B. 啤酒
C. 氢氯噻嗪
D. 肉汤
E. 苯溴马隆

正确答案：A、B、C、D。阿司匹林；啤酒；氢氯噻嗪；肉汤

解析：本题考查血尿酸水平升高。使血尿酸水平提高的食物和药品是:（1）生理性:食用高嘌呤食物 (动物的心肝肾脑、蛤、蚝、蚌、鱼卵、啤酒（B对）、肉脯、肉汁（D对）、沙丁鱼、酵母、肉精、干贝、鱼子、凤尾鱼、鲱鱼、大比目鱼、鲤鱼、野鸡、鹅、鸽、鹌鹑、火鸡、扇贝肉、咸猪肉、干豌豆、干豆、鸡汤、肉汤）、木糖醇摄入过多、剧烈运动、禁食。（2）药物：四氯化碳、铅中毒，或服用非甾体抗炎药（阿司匹林（A对）、贝诺酯）、利尿剂（氢氯噻嗪（C对）、托拉塞米、依他尼酸）、抗结核药（吡嗪酰胺、乙胺丁醇）等。苯溴马隆（E错）是促尿酸排泄药，所以不会引起高尿酸血症。